脑神经的躯体感觉核包括
A. 孤束核
B. 三叉神经脑桥核
C. 下泌涎核
D. 滑车神经核
E. 下泌涎核

正确答案：B。三叉神经脑桥核

解析：孤束核（A错）属于一般内脏感觉核；三叉神经脑桥核（B对）属于躯体感觉核；下泌涎核（C错）和下泌涎核（E错）属于一般内脏运动核；滑车神经核（D错）属于一般躯体运动核。